属于卵巢性索间质肿瘤的是
A. 卵黄囊瘤
B. 卵巢粘液性囊腺瘤
C. 卵巢黄素化囊肿
D. 卵巢颗粒细胞瘤
E. 成熟畸胎瘤

正确答案：D。卵巢颗粒细胞瘤

解析：卵巢性索间质肿瘤包括颗粒细胞－间质细胞瘤和支持细胞-间质细胞瘤。颗粒细胞－间质细胞瘤包括颗粒细胞瘤（D对），卵泡膜细胞瘤，纤维瘤。卵黄囊瘤，成熟畸胎瘤为卵巢生殖细胞肿瘤（AE错）。卵巢粘液性囊腺瘤为卵巢良性肿瘤（B错）。卵巢黄素化囊肿为良性疾病（C错）。